女性，30岁。停经43天，阴道少量出血伴右下腹隐痛2天。行吸宫术，病理报告为“蜕膜组织”。首先应考虑的疾病是
A. 闭经
B. 先兆流产
C. 月经
D. 月经不调
E. 异位妊娠

正确答案：E。异位妊娠

解析：异位妊娠多表现为6～8周的停经史，输卵管妊娠时，表现为一侧下腹隐痛或酸胀感，胚胎死亡后，常有不规则的阴道流血，将宫腔排出物做病理检查仅见蜕膜未见绒毛（见到绒毛为宫内妊娠）。患者为育龄期女性，停经43天，阴道少量出血伴右下腹隐痛，病理报告为“蜕膜组织”，根据临床表现和实验室检查，最可能的诊断是异位妊娠（E对）。闭经（A错）分为原发性闭经和继发性闭经，由于患者无闭经的症状，因此不考虑闭经。月经不调，指女性的月经周期不准时（忽慢忽快），月经量不正常（过多过少），月经血色有问题（或明或暗）。宫腔排出物为蜕膜组织不是先兆流产和月经不调的临床表现，因此不考虑先兆流产（B错）和月经不调（D错）。月经的成分不包括蜕膜组织，因此不考虑月经（C错）。